低镁血症时
A. 神经肌肉兴奋性降低
B. 心肌兴奋性降低
C. 两者均有
D. 两者均无
E. 无

正确答案：D。两者均无

解析：Mg2+和Ca2+竞争进入轴突，低镁血症时则Ca2+进入增多，导致轴突释放乙酰胆碱增多，使神经-肌肉接头处兴奋传递加强（A错）。低镁血症使心肌细胞静息电位负值减小，心肌细胞兴奋性升高（B错，故D为本题正确答案）。